不予医师执业注册的情形是
A. 受刑事处罚，刑罚执行完毕之日起不满三年或者受吊销医师执业证书行政处罚，自处罚之日起不满二年的
B. 受吊销医师执业证书行政处罚自处罚之日起不满三年的
C. 受刑事处罚、刑罚执行完毕之日起不满二年或者受吊销医师执业证书行政处罚，自处罚之日起不满三年的
D. 受刑事处罚、刑罚执行完毕之日起不满二年或者受吊销医师执业证书行政处罚，自处罚之日起不满二年的
E. 受刑事处罚，自刑事处罚执行完毕之日起不满五年的

正确答案：D。受刑事处罚、刑罚执行完毕之日起不满二年或者受吊销医师执业证书行政处罚，自处罚之日起不满二年的

解析：受刑事处罚、刑罚执行完毕之日起不满二年或者受吊销医师执业证书行政处罚，自处罚之日起不满二年的，不予医师执业注册（D对）。